中年男性，口唇疱疹，发热，头痛，神经系统症状，脑脊液检查提示：有核细胞数增多，蛋白轻度升高，糖与氯化物正常。考虑诊断为
A. 结核性脑膜炎
B. 单纯疱疹病毒性脑炎
C. 化脓性脑膜炎
D. 中毒性脑膜炎
E. 乙型脑炎

正确答案：B。单纯疱疹病毒性脑炎

解析：患者中年男性，口唇疱疹（单纯疱疹病毒性脑炎的病史），发热，头痛，神经系统症状（单纯疱疹病毒性脑炎的表现），脑脊液检查提示：有核细胞数增多，蛋白轻度升高，糖与氯化物正常（单纯疱疹病毒性脑炎的脑脊液检查结果）。结合患者的表现和辅助检查，考虑诊断为单纯疱疹病毒性脑炎（B对）。